患者，女，76岁，慢性阻塞性肺病病史10年，一年来多次因急性加重入院，予以抗感染等治疗。近日因咳嗽咳痰加重再次入院，经验性抗感染治疗时适宜选用的药物是
A. 阿奇霉素
B. 阿米卡星
C. 头孢他啶
D. 头孢唑林
E. 美罗培南

正确答案：C。头孢他啶

解析：本题考查头孢他啶。经验性抗感染治疗时适宜选用的药物是头孢他啶（C对）。老年人、有基础疾病或需要住院的患者治疗社区获得性肺炎，常用第二、三代头孢菌素（如头孢他啶）、β-内酰胺类/β-内酰胺酶抑制剂，碳青霉烯类或氟喹诺酮类。头孢唑林（D错）用于青壮年和无基础疾病的CAP患者治疗社区获得性肺炎。